呈扁圆柱形，略弯曲，表面灰黄色或暗灰色，具纵纹及横裂纹，有的皮部横向断离露出木部，形似连珠的药材是
A. 远志
B. 胡黄连
C. 百部
D. 巴戟天
E. 茜草

正确答案：D。巴戟天

解析：本题考查的是巴戟天药材的性状鉴别。呈扁圆柱形，略弯曲，表面灰黄色或暗灰色，具纵纹及横裂纹，有的皮部横向断离露出木部，形似连珠的药材是巴戟天（D对）。巴戟天：【性状鉴别】药材为扁圆柱形，略弯曲，长短不等。表面灰黄色或暗灰色，具纵纹及横裂纹，有的皮部横向断离露出木部，形似连珠。质坚韧，断面皮部厚，紫色或淡紫色，易与木部剥离；木部坚硬，黄棕色或黄白色。气微，味甘而微涩。远志（A错）：【性状鉴别】药材呈圆柱形，略弯曲。表面灰黄色至灰棕色，有较密并深陷的横皱纹、纵皱纹及裂纹，老根的横皱纹更密更深陷，略呈结节状。质硬而脆，易折断，断面皮部棕黄色，抽去木心者中空，未去净者木部黄白色，皮部易与木部剥离。气微，味苦、微辛，嚼之有刺喉感。胡黄连（B错）：【性状鉴别】药材呈圆柱形，略弯曲，偶有分枝。表面灰棕色至暗棕色，粗糙，有较密的环状节，具稍隆起的芽痕或根痕，上端密被暗棕色鳞片状的叶柄残基。体轻，质硬而脆，易折断，断面略平坦，淡棕色至暗棕色，断面木部有4～10个类白色点状维管束排列成环。气微，味极苦。百部（C错）：【性状鉴别】药材直立百部呈纺锤形，上端较细长，皱缩弯曲。表面黄白色或淡棕黄色，有不规则深纵沟，间或有横皱纹。质脆，易折断，断面平坦，角质样，淡黄棕色或黄白色，皮部较宽，中柱扁缩。气微，味甘、苦。茜草（E错）：【性状鉴别】药材根茎呈结节状，丛生粗细不等的根。根呈圆柱形略弯曲或扭曲；表面红棕色或暗棕色，具细纵皱纹及少数细根痕；皮部易剥落，露出黄红色木部。质脆，易折断，断面平坦，皮部狭，紫红色，木部宽广，浅黄红色，导管孔多数。气微，味微苦，久嚼刺舌。